近年来，随着经济的发展可能带来的健康问题有
A. 营养不良、心理障碍、精神分裂症
B. 传染病、车祸、心理紧张
C. 慢性非传染性疾病、心理紧张、环境污染
D. 环境污染、婴儿死亡率增高、人口寿命降低
E. 新型传染病、心理紧张、贫血

正确答案：C。慢性非传染性疾病、心理紧张、环境污染

解析：本题考查经济发展带来新的健康问题。近年来，随着经济的发展可能带来的健康问题有：1.环境污染和生态破坏；2.生活方式改变；3.现代社会病的产生；4.心理健康问题的凸显（C对ABDE错）；5.负性社会事件的增多；6.社会人口特征的剧烈变化。